酿成较大规模的流行或发生世界性大流行的原因是
A. 流感病毒型别多,毒力强
B. 流感病毒抗原性弱,免疫力不强
C. HA和NA之间易发生基因重组
D. HA和NA易发生点突变
E. 甲型流感病毒易形成新的亚型

正确答案：D。HA和NA易发生点突变

解析：甲型流感病毒的变异：甲型流感病毒HA和NA易发生变异，其变异有两种形式，一种是抗原漂移，其变异幅度小，属量变，这种变异可引起中、小型规模的流行；另一种是抗原转换，其变异幅度大，形成新亚型。由于人群对新亚型流感病毒缺乏免疫力，往往酿成较大规模的流行或发生世界性大流行。掌握“正、副黏病毒”知识点。